易引起亚硝酸盐中毒的是
A. 罐装饮料
B. 农药喷洒蔬菜
C. 腌菜
D. 粗制棉籽油
E. 方便面

正确答案：C。腌菜

解析：本题考查易引起亚硝酸盐中毒的食物。腌菜（C对ABDE错）中亚硝酸盐含量较高，易引起亚硝酸盐中毒。